男性，38岁，上腹痛病史半年，每年秋春季节发病，多在夜间痛，向背部放射，多次排柏油样便。查体：上腹正中偏右轻压痛，钡餐，胃和十二指肠球部未见溃疡现象，诊断最可能为
A. 慢性胃炎
B. 胃神经官能症
C. 幽门管溃疡
D. 球后溃疡
E. 十二指肠球炎

正确答案：D。球后溃疡